患儿，女，6个月。诊断为化脓性脑膜炎，经抗感染治疗后，脑脊液恢复正常，停药后2天再次发热，并出现惊厥，考虑合并硬脑膜下积液，最简便易行的检查是
A. 头颅B超
B. 头颅CT
C. 头颅MRI
D. 颅骨透照试验
E. 硬膜下穿刺

正确答案：D。颅骨透照试验

解析：头颅B超（A错）、头颅CT（B错）、头颅MRI（C错）都属于影像学检查，婴幼儿尤其应注意辐射防护，最好避免放射学检查。颅骨透照试验（D对）简单易行，可确定硬膜下积液的位置、范围。硬膜下穿刺（E错）是确诊硬膜下积液的金标准，但属于创伤性检查。